非参数检验的特点之一是
A. 检验效率优于参数检验
B. 直接检验多个总体均数是否相同
C. 犯第Ⅱ类错误的概率小于参数检验
D. 与参数检验的检验效果相同
E. 可用于非正态分布数据

正确答案：E。可用于非正态分布数据